茎突前间隙又可称为
A. 咽旁前间隙
B. 咽旁后间隙
C. 咽旁间隙
D. 咽后间隙
E. 食管后间隙

正确答案：A。咽旁前间隙

解析：咽旁间隙由茎突及茎突诸肌将其分为前后两部：前部称咽旁前间隙（或称茎突前间隙）；后部称咽旁后间隙（或称茎突后间隙）。掌握“面侧深区及颌面部各间隙的境界”知识点。